“一种心理测量的工具”称为
A. 心理评估
B. 心理鉴定
C. 心理测验
D. 心理观察
E. 心理调查

正确答案：C。心理测验